下列哪项是青春期开始的重要标志
A. 卵泡开始发育
B. 月经初潮
C. 出现周期性排卵
D. 第二性征开始发育
E. 第一性征开始发育

正确答案：B。月经初潮

解析：月经初潮为青春期的重要标志。通常发生于乳房发育2.5年。此时月经周期常不规则。乳房发育是女性第二性征的最初特征，为女性青春期发动的标志。掌握“女性生殖系统生理”知识点。